附着丧失可以表示
A. 牙周炎炎症程度
B. 牙龈炎炎症程度
C. 牙槽骨吸收程度
D. 牙周组织破坏程度
E. 牙周炎的诊断指标

正确答案：D。牙周组织破坏程度

解析：本题考查附着丧失。附着丧失是牙周支持组织破坏的结果，可通过结合上皮冠方至釉牙骨质界的距离来描述，用来表示牙周组织破坏程度（D对）。炎症明显的牙周炎在经治疗后炎症减轻或消退，此时仍可有附着丧失，所以不能用附着丧失表示牙周炎炎症程度（A错）。附着丧失只发生在牙周炎患者，不发生在牙龈炎患者，所以附着丧失不能用来表示牙龈炎炎症程度（B错）。附着丧失指袋底至釉牙骨质界的距离，牙槽骨吸收可分为水平型吸收和垂直型吸收，其吸收程度一般按吸收区占牙根长度的比例来描述，不用附着丧失描述（C错）。牙周炎的诊断指标（E错）是牙周袋形成和牙槽骨吸收，不是附着丧失。